下列有关二噁英类的说法，错误的是
A. 二噁英类有免疫毒性
B. 主要来源于城市和工业垃圾焚烧
C. 氯苯是二噁英类合成的唯一前体
D. 人体内二噁英类的主要来源是食物
E. 二噁英类可使雄性动物雌性化

正确答案：C。氯苯是二噁英类合成的唯一前体

解析：本题考查二噁英类的相关内容。二噁英是一类有机氯化合物，大气中二噁英主要来源于城市和工业垃圾焚烧（B对）。排放到大气环境中的二噁英多吸附在颗粒物上，沉降到水体和土壤，然后通过食物链的富集作用进入人体。因此，食物是人体内二噁英的主要来源（D对）。二噁英类对健康的影响有很多，它具有免疫毒性（A对），也可使雄性动物雌性化（E对）。氯苯是二噁英类合成的唯一前体（C错，为本题正确答案）是错误的。